下列速发型矽肺发生的条件中哪项是错误的
A. 吸入高浓度粉尘
B. 游离SiO2含量很高
C. 高分散度
D. 接尘者身体比较虚弱
E. 无任何防尘措施

正确答案：D。接尘者身体比较虚弱

解析：本题考查速发型矽肺的诱因。矽肺的发病受多种因素影响，粉尘的分散度越高（C对），导致矽肺的能力越强；当防护措施不到位甚至毫无防护措施（E对）时，会大大增加矽肺的发病概率。速发型矽肺是指由于持续吸入高浓度（A对）、高游离SiO₂含量（B对）的粉尘，经1～2年即发病者。矽肺的发病与接触者个体因素有关，但接尘者身体虚弱（D错，为本题正确答案）不是速发型矽肺的发生条件。